种植体周围龈沟的深度应小于
A. 5mm
B. 3mm
C. 4mm
D. 2mm
E. 1mm

正确答案：B。3mm

解析：本题考查种植义齿修复原则。种植体周围龈沟的深度应小于3mm（B对）。